由于梅毒螺旋体引起的牙齿畸形，切牙切缘常有一新月形凹陷，或深裂隙，称为
A. 哈钦森切牙
B. 桑葚状磨牙
C. 牛牙症
D. 特纳牙
E. 氟牙症

正确答案：A。哈钦森切牙

解析：先天梅毒螺旋体受累的切牙称哈钦森切牙，其近远中面向切缘而不是牙颈部逐渐变细，形成螺丝刀样外观，切缘中间常有一新月形凹陷或深裂隙。掌握“氟牙症、先天性梅毒牙与牙本质形成缺陷”知识点。